伴发热，査体：右小腿皮肤片状红疹，颜色鲜红，中间较淡，边缘清楚，隆起，皮温增高。最可能的诊断是
A. 疖
B. 痈
C. 急性蜂窝织炎
D. 丹毒
E. 急性淋巴结炎

正确答案：D。丹毒

解析：患者右小腿疼痛2天伴发热，表现为片状红疹，颜色鲜红，中间较淡，边缘清楚，隆起，皮温增高。最可能的诊断应为丹毒（D对）。丹毒（P111）是皮肤淋巴管网受乙型溶血链球菌侵袭感染所致的急性非化脓性炎症。好发于下肢及面部。起病急，开始即可有畏寒、发热、头痛、全身不适等。病变多见于下肢，表现为片状皮肤红疹，微隆起、色鲜红、中间稍淡、境界较清楚，病变区域皮温增高。疖（P108）（A错）和痈（P108）（B错）为金葡菌引起的毛囊的化脓性感染，局部有硬结和脓点。急性蜂窝织炎（P110）（C错）炎症不易局限，与正常组织分界不清。急性淋巴结炎（P111）（E错）沿淋巴结周围组织产生炎性反应，局部淋巴结肿大、有疼痛和触痛，但表面皮肤正常。